可导致牙龈增生的药物有
A. 环孢素
B. 青霉素
C. 甲硝唑
D. 四环素
E. 布洛芬

正确答案：A。环孢素

解析：本题考查药物性牙龈肥大的病因。可导致牙龈增生的药物有环孢素（A对）。由药物引起的牙龈增生称为药物性牙龈肥大，是指长期服用某些药物而引起牙龈的纤维性增生和体积增大。与药物性龈肥大有关的三类常用药物是：①抗癫痫药物—苯妥英钠；②免疫抑制剂—环孢素；③钙通道阻滞剂如硝苯地平、维拉帕米等。环孢素作为免疫抑制剂，常用于器官移植或某些自身免疫性疾病患者，服用此药者约有30%～50%发生牙龈纤维性增生。青霉素（B错）是一种高效、低毒、临床应用广泛的重要抗生素，长期应用会造成机体过敏以及耐药性的出现，不会造成牙龈增生。甲硝唑（C错）是一种高效价廉、能杀灭专性厌氧菌的药物，用以治疗牙周炎和坏死性溃疡性龈炎，该药不引起牙龈增生。四环素（D错）为广谱抗生素，对侵袭性牙周炎有较好的临床疗效，服用后一般不引起牙龈增生。布洛芬（E错）具有抗炎、镇痛、解热的作用，长期服用可造成消化不良、胃烧灼感、胃痛、恶心、呕吐，一般不引起牙龈增生。